抗抑郁药的种类包括
A. 选择性5-HT再摄取抑制剂
B. 选择性NA再摄取抑制药
C. 非选择性5-HT和NA再摄取抑制药
D. 中枢胆碱酯酶抑制药
E. 单胺氧化酶抑制药

正确答案：A、B、C、E。选择性5-HT再摄取抑制剂；选择性NA再摄取抑制药；非选择性5-HT和NA再摄取抑制药；单胺氧化酶抑制药

解析：本题考查抗抑郁药。抗抑郁药根据化学结构及作用机制的不同可分为选择性5-羟色胺（5-HT）再摄取抑制剂（A对）、5-HT及去甲肾上腺素再摄取抑制剂（C对）、去甲肾上腺素能及特异性5-HT能抗抑郁药、三环类抗抑郁药、四环类抗抑郁药、单胺氧化酶抑制剂（E对）、选择性去甲肾上腺素能抑制剂（B对）及其他类。中枢胆碱酯酶抑制药（D错）可用于阿尔茨海默病的治疗。